患者，女，30岁。10年前患风湿热，检查：心尖部听到舒张期隆隆样杂音，X线显示左心房增大。应首先考虑的是
A. 二尖瓣关闭不全
B. 二尖瓣狭窄
C. 主动脉瓣关闭不全
D. 主动脉瓣狭窄
E. 肺动脉瓣狭窄

正确答案：B。二尖瓣狭窄

解析：患者青年女性，10年前患风湿热，检查：心尖部听到舒张期隆隆样杂音，X线显示左心房增大，故患者应首先考虑的是风心病导致的二尖瓣狭窄（B对）。二尖瓣关闭不全典型的心脏杂音为心尖区全收缩期吹风样杂音（A错）。主动脉瓣关闭不全典型杂音为胸骨右缘1～2肋间舒张期高调递减型叹气样杂音（C错）。主动脉瓣狭窄典型的心脏杂音为胸骨右缘1～2肋间收缩期粗糙而响亮的射流性杂音（D错）。肺动脉瓣狭窄典型的心脏杂音为胸骨左缘第二肋间有2～4级粗糙收缩期喷射样杂音（E错）。